欲比较两种药物的效果是否有差别，若疗效评定为“很有效，较有效，效果一般，基本无效”，宜采用的统计分析方法是
A. 卡方检验
B. t检验
C. 方差分析
D. 回归分析
E. 秩和检验

正确答案：E。秩和检验

解析：用“有效、一般、无效”作为指标，属于非参数检验方法，因此应选择秩和检验（E对）。卡方检验就是统计样本的实际观测值与理论推断值之间的偏离程度，实际观测值与理论推断值之间的偏离程度就决定卡方值的大小。t检验是用t分布理论来推论差异发生的概率，从而比较两个平均数的差异是否显著。方差分析，用于两个及两个以上样本均数差别的显著性检验。回归分析是确定两种或两种以上变量间相互依赖的定量关系的一种统计分析方法。由此可见，卡方检验（A错）、t检验（B错）、方差分析（C错）和回归分析（D错）都是参数检验方法，故不选择。